男性，27岁，尿频，尿急，尿痛1年，一般抗炎治疗不好转，时有低热无力，尿检：白细胞20～30/HP，红细胞5～8/HP，肾图：右肾严重受损，左肾积水，初诊为肾结核。确诊右肾结核左肾积水，为了治疗哪项检查更好
A. 血Cr
B. 尿结核菌培养
C. 右肾穿刺造影
D. 肾扫描
E. 左肾穿刺造影

正确答案：A。血Cr

解析：青年男性患者，确诊为右肾结核左肾积水，右肾严重受损，需行右肾切除治疗，为明确手术时机，需了解积水侧肾功，临床上检测血清Cr（A对）是常用的了解肾功能的主要方法之一。明确诊断右肾结核，右肾严重破坏，肾自截，功能基本没有，所以血肌酐可以直接等同于左肾功能，而且肾穿刺造影在临床上很少用，肾积水再穿刺一会导致感染，二造影剂不容易代谢掉。尿结核菌培养（B错）可用于诊断肾结核，但对肾结核的治疗无临床价值。肾扫描（D错）也可了解肾功能，但费用昂贵且较复杂，一般不用于术前准备的检测。肾穿刺造影（CE错）主要用于肾血管疾病、肾损伤和肾实质肿瘤的检查，一般不用于肾结核。